引起水体富营养化的污染物是
A. 有机物
B. 无机物
C. Ca
D. Hg
E. P

正确答案：E。P

解析：本题考查引起水体富营养化的污染物。水体富营养化指的是水体中N、P（E对ABCD错）等营养盐含量过多而引起的水质污染现象。